既开窍醒神，又活血散结的药是
A. 冰片
B. 远志
C. 麝香
D. 苏合香
E. 石菖蒲

正确答案：C。麝香

解析：本题考查的是麝香的功效。既开窍醒神，又活血散结的药是麝香（C对）。麝香：【功效】开窍醒神，活血通经，消肿止痛。冰片（A错）：【功效】开窍醒神，清热止痛。石菖蒲（E错）：【功效】开窍宁神，化湿和胃。远志（B错）：【功效】安神益智，祛痰开窍，消散痈肿。苏合香（D错）：【功效】开窍辟秽，止痛。